不合理用药的常见不良反应后果有
A. 浪费医药资源
B. 延误疾病治疗
C. 导致医疗纠纷
D. 造成诊断失误
E. 引发药源性疾病

正确答案：A、B、C、E。浪费医药资源；延误疾病治疗；导致医疗纠纷；引发药源性疾病

解析：本题考查的是不合理用药的后果。不合理用药的常见不良反应后果有浪费医药资源（A对）、延误疾病治疗（B对）、导致医疗纠纷（C对）与引发药源性疾病（E对）。不合理用药的后果：1.浪费医药资源。2.延误疾病的治疗。3.引发药物不良反应及药源性疾病的发生。4.造成医疗事故和医疗纠纷。